一位外科手术前的病人，坐卧不安，眉头紧锁，小动作多，这一现象是
A. 应激的行为反应
B. 应激的情绪反应
C. 应激的生理反应
D. 应激的防御反应
E. 以上都不是

正确答案：B。应激的情绪反应